月经后期是指月经周期推迟多少天以上
A. 3天以上
B. 5天以上
C. 7天以上
D. 8天以上
E. 10天以上

正确答案：C。7天以上

解析：月经后期即月经周期推迟7天以上（C对），甚至3-5个月一行，连续出现2个周期以上。